孕期动物最容易感染，感染后常引起流产，但人感染后不引起流产的人兽共患的病原菌为
A. 耶尔森氏菌属
B. 炭疽芽胞杆菌
C. 布鲁氏菌属
D. 流感嗜血杆菌
E. 铜绿假单胞菌

正确答案：C。布鲁氏菌属

解析：孕期动物对布鲁氏菌最易感，感染后常引起流产，但人感染后不引起流产。掌握“动物源性细菌”知识点。